髙致病性病原微生物是指
A. 第一类病原微生物
B. 第二类病原微生物
C. 第三类病原微生物
D. 第一类和第二类病原微生物
E. 第二类和第三类病原微生物

正确答案：D。第一类和第二类病原微生物